下列哪项不是女型骨盆的特点
A. 两侧坐骨棘间径≤10cm
B. 为女性正常骨盆
C. 入口呈横椭圆形
D. 髂骨翼宽而浅
E. 耻骨弓较宽

正确答案：A。两侧坐骨棘间径≤10cm

解析：女型骨盆入口呈横椭圆形（C对），入口的横径长于前后径（D对），耻骨弓较宽（E对）。坐骨棘间径大于10cm（A错，为本题正确答案），坐骨棘短小。此型属最常见的正常骨盆（B对），在我国妇女中占52%～58.9%。